目前国外多数学者将发生于颌骨的巨细胞肉芽肿与骨巨细胞瘤合称为
A. 颌骨纤维性变
B. 颌骨巨细胞病变
C. 颌骨结核病
D. 颌骨嗜酸性腺瘤
E. 颌骨巨细胞鳞癌

正确答案：B。颌骨巨细胞病变

解析：目前国外多数学者主张将发生于颌骨的巨细胞肉芽肿与骨巨细胞瘤统称为颌骨巨细胞病变，其临床行为具有一个较宽的变化谱，可表现非侵袭性和侵袭性特点。掌握“颌骨的非肿瘤性疾病”知识点。